面神经支配
A. 咬肌
B. 颞肌
C. 翼外肌
D. 翼内肌
E. 颊肌

正确答案：E。颊肌

解析：在面神经的颅外分支中，面神经颊支沿腮腺管走行，支配颊肌（E对）、口轮匝肌及其他口周围肌。咬肌（A错）、颞肌（B错）、翼内肌（D错）、翼外肌（C错）均由三叉神经的小分支咀嚼肌神经支配。